β-胡萝卜素主要来自于
A. 橙色水果
B. 黄橙色蔬菜
C. 深绿色蔬菜
D. 番茄
E. 肝脏

正确答案：B。黄橙色蔬菜